在3～4岁时腮腺导管的开口应在
A. 上颌第一乳磨牙相对的颊黏膜处
B. 上颌第二乳磨牙相对的颊黏膜处
C. 上颌第一恒磨牙相对的颊黏膜处
D. 上颌第二恒磨牙相对的颊黏膜处
E. 上颌第三恒磨牙相对的颊黏膜处

正确答案：B。上颌第二乳磨牙相对的颊黏膜处

解析：腮腺在胚胎第6周开始发育，上皮芽最初形成处为腮腺导管的开口。此开口最初在上颌第一乳磨牙相对的颊黏膜处；在3～4岁时位于上颌第二乳磨牙相对的颊黏膜。掌握“腮腺咬肌区、腮腺与面神经解剖关系”知识点。